血友病属于
A. 酶缺陷所致疾病
B. 细胞蛋白缺陷所致疾病
C. 受体缺陷所致疾病
D. 膜转运障碍所致疾病
E. 基因突变所致疾病

正确答案：E。基因突变所致疾病

解析：甲型血友病是由于位于X染色体上的凝血因子调基因发生缺失、插入或点突变，导致凝血因子VIII活性缺失、凝血障碍、出血倾向，属于基因突变所致疾病（E对）。